患者，男，70岁。喘促气短，声低气怯，咳声低弱，咳痰稀白，自汗畏风，舌淡红苔薄白，脉弱无力。治疗应首选
A. 三子养亲汤合二陈汤
B. 生脉散合补肺汤
C. 七味都气丸合生脉散
D. 参蛤散合金匮肾气丸
E. 苏子降气汤合二陈汤

正确答案：B。生脉散合补肺汤

解析：根据“喘促气短”可知病为“喘证”；根据“声低气怯，咳声低弱，咳痰稀白，自汗畏风，舌淡红苔薄白，脉弱无力”可辨为“肺虚证”，方用生脉散合补肺汤（B对）补肺益气。三子养亲汤合二陈汤为实喘之痰浊阻肺证的代表方（A错）。七味都气丸合生脉散主治虚喘之肾阴虚证（C错）。参蛤散合金匮肾气丸为虚喘之肾虚证的代表方（D错）。苏子降气汤为肺胀之痰浊壅肺的代表方（E错）。